可作为诊断腮腺炎病毒性脑炎依据的是
A. 发热，惊厥伴口唇疱疹
B. 嗜睡，头痛伴失语
C. 发热，惊厥伴两侧以耳垂为中心肿胀
D. 烦躁，易激惹伴前囟饱满
E. 呕吐，血压升高，惊厥伴斑丘疹

正确答案：C。发热，惊厥伴两侧以耳垂为中心肿胀

解析：腮腺炎病毒性脑炎其临床主要表现为在流行性腮腺炎病程中出现发热、头痛、呕吐、嗜睡、颈强直等，故可作为诊断腮腺炎病毒性脑炎依据的是发热，惊厥伴两侧以耳垂为中心肿胀（C对）。发热，惊厥伴口唇疱疹（A错）需注意单纯疱疹病毒性脑炎。嗜睡，头痛伴失语（B错）需注意颅内出血或者颅内占位性病变。烦躁，易激惹伴前囟饱满（D错）需注意化脓性脑膜炎。呕吐，血压升高，惊厥伴斑丘疹（E错）需注意肠道病毒性脑炎。